患者，男，18岁。因高热，胸痛，咯铁锈色痰入院。检查：急性热病病容，体温40℃，脉搏102次/分，X线胸片示左上肺大片片状阴影，白细胞19×10⁹/L。治疗应首选
A. 青霉素加麻杏石甘汤
B. 输液加给氧
C. 糖皮质激素
D. 红霉素加庆大霉素
E. 病毒唑加退热药

正确答案：A。青霉素加麻杏石甘汤

解析：患者高热，胸痛，咯铁锈色痰，X线胸片示左上肺大片片状阴影，白细胞升高，故可诊断为肺炎球菌肺炎，首选治疗措施为尽早使用抗生素青霉素G抗感染。咳嗽，咳痰黄稠或咳铁锈色痰，高热不退，为痰热壅肺证，治疗需清热化痰，宽胸止咳，中药选用麻杏石甘汤加减（A对）（BCD错）。病毒唑加退热药（E错）可用于治疗病毒性肺炎。